患者男性，30岁，处于HBV感染恢复阶段。抗-HBc（+），HBsAg（+），抗-HBs（+），抗HBc-IgM（+）。请从以下选项中选出一个最佳答案
A. 以上指标均正常
B. 以上指标只有一项正常
C. 以上指标有两项不正常
D. 以上指标有三项不正常
E. 以上指标均不正常

正确答案：C。以上指标有两项不正常

解析：在HBV感染恢复阶段，抗-HBc及抗-HBs均为阳性，HBsAg及抗HBc-IgM均为阴性，故有两项指标不正常。掌握“口外一般检查及辅助检查”知识点。